属于自由基清除剂，用于治疗缺血性脑血管病的药物是
A. 尼莫地平
B. 吡拉西坦
C. 依达拉奉
D. 多奈哌齐
E. 尼麦角林

正确答案：C。依达拉奉

解析：本题考查依达拉奉。属于自由基清除剂，用于治疗缺血性脑血管病的药物是依达拉奉（C对）；尼莫地平（A错）属于钙通道阻滞剂，用于高血压；吡拉西坦（B错）为酰胺类脑功能改善及抗记忆障碍药；多奈哌齐（D错）属于乙酰胆碱脂酶抑制剂，用于改善脑功能及抗记忆障碍；尼麦角林（E错）属于直接作用于血管平滑肌的血管扩张剂，主要用于急、慢性脑血管疾病和代谢性脑供血不足。